女，反复咳嗽多年，今日突发咯血200毫升，之前偶有咯血。胸片提示多发囊状改变。明确诊断的检查是
A. 胸部CT
B. 支气管动脉造影
C. 支气管镜
D. PET-CT
E. 磁共振

正确答案：A。胸部CT

解析：该患者女，出现反复咳嗽，突发咯血200毫升，之前偶有咯血。胸片提示多发囊状改变，结合患者的表现和辅助检查，判断为支气管扩张症表现，为明确诊断应行胸部CT检查（A对）。支气管动脉造影术和栓塞术：对咯血有较好的诊治价值（B错）。纤维支气管镜检查：当支气管扩张呈局灶性且位于段支气管以上时，可发现弹坑样改变，可通过纤维支气管镜采样用千病原学诊断及病理诊断。纤支镜检查还可明确出血、扩张或阻塞的部位，还可经纤支镜进行局部灌洗，采取灌洗液标本进行涂片、细菌学和细胞学检查，协助诊断和指导治疗（C错）。正电子发射型计算机断层显像(PET)：可以较准确地对肺癌、纵隔淋巴结转移及远处转移进行鉴别诊断（D错）。磁共振成像(MRI)：对纵隔疾病和肺栓塞诊断有重要意义（E错）。